假设研制出一种预防丙型肝炎的疫苗，要评价此疫苗的效果，你会选择哪个人群作为你的研究对象
A. 已感染有丙型肝炎的人群
B. 丙型肝炎发病率低的人群
C. 曾感染过丙型肝炎，且体内有抗体的人群
D. 丙型肝炎的高危人群
E. 以上都不行

正确答案：D。丙型肝炎的高危人群

解析：本题考查实验流行病学的研究对象选择。在实验流行病学的研究对象选择中，应选择预期发病率较高的人群。在本题中评价丙肝疫苗的预防效果，应选择在疾病高发区人群中进行，即选择丙型肝炎的高危人群（D对ABCE错）。